下列感染中，没有传染性的是
A. 隐性感染
B. 显性感染潜伏期
C. 显性感染症状明显期
D. 病原携带状态
E. 潜伏性感染

正确答案：E。潜伏性感染

解析：潜伏感染是由于机体免疫功能足以将病原体局限化而不引起显性感染，成为携带者；待机体免疫功能下降时，才引起显性感染（E对）。隐性感染（A错）、显性感染潜伏期（B错）、显性感染症状明显期（C错）、病原携带状态（D错）皆有传染性。